患者身热反不恶寒，甚至面赤，欲寐，四肢厥冷，下利清谷，食入即吐，脉微细，其临床意义是
A. 少阴病寒化证
B. 太阴腹痛证
C. 太阴病本证
D. 厥阴病寒热错杂证
E. 太阳腑证

正确答案：A。少阴病寒化证

解析：少阴寒化证是指病邪深入少阴，心肾阳气虚衰，从阴化寒，阴寒独盛所表现的虚寒证。患者体内阴寒盛极，格阳于外，虚阳外浮，则出现身热反不恶寒，甚至面赤的假热之象；心肾阳气衰微，神失所养，故见但欲寐；四肢为诸阳之本，阳衰失于温运，故四肢厥冷；肾阳虚衰，火不暖土，脾胃纳运升降失调，故下利清谷，食入即吐；心肾阳衰，无力鼓动血行，故脉微细；故辨证为少阴病寒化证（A对）。太阴腹痛证的临床表现腹满时痛或大实痛，拒按（B错）。太阴病本证的临床表现是腹满而吐，食不下，口不渴，自利，时腹自痛，四肢欠温，脉沉缓而弱（C错）。厥阴病寒热错杂证的临床表现是消渴，气上撞心，心中疼热，饥而不欲食，食则吐蛔（D错）。太阳蓄水证的临床表现是发热，恶寒，小腹满，小便不利，口渴，或水入则吐，脉浮或浮数。太阳蓄血证的临床表现是少腹急结或硬满，小便自利，如狂或发狂，善忘，大便色黑如漆，脉沉涩或沉结（E错）。